类毒素刺激机体后产生的特异性免疫应答物质是
A. 干扰素
B. 抗毒素
C. 补体
D. 乙型溶素
E. 细胞因子

正确答案：B。抗毒素